纤维结构不良单骨性病变较多见，常累及以下哪个部位的骨
A. 颌骨
B. 肱骨
C. 耻骨
D. 盆骨
E. 肋骨

正确答案：A。颌骨

解析：纤维结构不良单骨性病变较多见，约占80%，常累及颌骨，其他常见发病部位还有肋骨和股骨等。掌握“颌骨的非肿瘤性疾病”知识点。